死产或早产多出现在
A. 梅毒一期
B. 梅毒二期
C. 梅毒三期
D. 早期先天梅毒
E. 晚期先天梅毒

正确答案：D。早期先天梅毒

解析：本题考查出现死产或早产的梅毒时期。梅毒是由梅毒螺旋体引起的一种慢性性传播疾病，后天梅毒约95%以上通过性传播传染，先天梅毒通过胎盘传染。通过胎盘传播可引起流产、早产、死产和胎传梅毒。病程小于2年者，为早期梅毒，故出现死产或早产的为早期先天梅毒（D对）。获得性梅毒（后天梅毒）分为：梅毒一期（A错）、梅毒二期（B错）、梅毒三期（C错），是后天获得的，不会出现死产或早产。晚期先天梅毒（E错）多在2岁以后发病，因而也不会出现死产或早产。